乳房的淋巴引流，错误的是
A. 乳房中央及外侧部的淋巴管注入肩胛下淋巴结
B. 乳房上部的淋巴管主要注入腋尖淋巴结
C. 乳房内侧部的淋巴管注入胸骨旁淋巴结
D. 乳房下部的淋巴管注入膈上淋巴结(前组)
E. 胸肌淋巴结接受乳房外侧部和中央部淋巴的回流

正确答案：A。乳房中央及外侧部的淋巴管注入肩胛下淋巴结

解析：乳房中央及外侧部淋巴注入胸肌淋巴结（E对A错，为本题正确答案）。乳房上部的淋巴管主要注入腋尖淋巴结（B对），内侧部的淋巴管注入胸骨旁淋巴（C对），乳房下部的淋巴管注入膈上淋巴结(前组)（D对）。